环境卫生学的研究对象是
A. 自然环境、生活环境和社会环境
B. 人群健康
C. 生物地球化学疾病
D. 人类健康及其周围环境
E. 环境污染的综合治理

正确答案：D。人类健康及其周围环境

解析：本题考查环境卫生学的研究对象。环境卫生学以人类及其周围的环境（D对ABCE错）为研究对象，阐明人类赖以生存的环境对人体健康的影响及人体对环境作用所产生的反应，即环境与机体相互作用，这是环境卫生学的基本任务。